属于注射剂一般检查项目的有
A. 装量
B. 含量均匀度
C. 无菌
D. 热原或细菌内毒素
E. 不溶性微粒

正确答案：A、C、D、E。装量；无菌；热原或细菌内毒素；不溶性微粒